外源性凝血系统的激活是
A. 凝血因子Ⅻ与胶原、内毒素接触后被激活
B. 凝血因子Ⅻ被激肽释放酶等水解而激活
C. 两者都是
D. 两者都不是
E. 无

正确答案：D。两者都不是

解析：外源性凝血系统的激活是凝血因子Ⅻ与胶原、内毒素接触后被激活和凝血因子Ⅻ被激肽释放酶等水解而激活。外源性凝血系统的激活是血液中的 FVll含有 Ca2+结合氨基酸，组织因子释放后，形成 TF-Ca2+-VII复合物，FVll被激活为FVlla。TF-Vlla 可激活FX,FXa与Va、PL-Ca2+形成凝血酶原激活物，凝血酶原被激活为凝血酶，凝血酶使纤维蛋白原转变为纤维蛋白单体，纤维蛋白单体相互聚合，最终形成不溶于水的交联纤维蛋白多聚体；凝血酶还可使血小板活化，从而启动凝血过程。此外，TF-Vlla除激活FX以外，还可激活FlX,FlXa与VIII a、PL-C汒形成X因子激活物，产生更多的凝血酶，呈现放大效应。凝血因子Ⅻ与胶原、内毒素接触后被激活（A错）和凝血因子Ⅻ被激肽释放酶等水解而激活（B错，D为本题正确答案）是内源性凝血系统的激活。